65岁及以上人口数与15～65岁人口数之比是指什么，表明每100名劳动年龄人口所抚养的老年人口数
A. 老年人口系数
B. 少年人口系数
C. 老龄化指数
D. 总抚养比
E. 老年人口抚养比

正确答案：E。老年人口抚养比